男，55岁。腹胀、少尿1年。曾诊断为“乙肝肝硬化”，未系统治疗。近1天呕血2次，量约500ml，排黑便1次，约100g，感头晕、心悸，于县医院急症就诊。既往有冠心病病史2年，间断口服药物治疗。查体：血压80/50mmHg，神志清，贫血貌，巩膜轻度黄染。心率108次/min，律齐。全腹无压痛及反跳痛，肝肋下未触及，脾肋下2cm，腹水征（+），肠鸣音活跃。应首先采取的措施是
A. 急诊手术治疗
B. 注射垂体后叶素
C. 急诊胃镜检查
D. 口服普萘洛尔
E. 补液、扩容

正确答案：E。补液、扩容